对若干有代表性的地区和人群，按照统一的监测方案，定时、定点所开展的连续监测属于
A. 常规报告
B. 被动监测
C. 哨点监测
D. 主动监测
E. 症状监测

正确答案：C。哨点监测

解析：本题考查哨点监测。哨点监测是为了更清楚地了解某些疾病在不同地区、不同人群的分布以及相应的影响因素等，根据被监测疾病的流行特点，选择若干有代表性的地区和（或）人群，按统一的监测方案连续地开展监测。题干对若干有代表性的地区和人群，按照统一的监测方案，定时、定点所开展的连续监测属于哨点监测（C对ABDE错）。